牙周膜中维持直立的主要纤维是
A. 牙槽嵴组
B. 水平组
C. 斜行组
D. 牙骨膜组
E. 根间组

正确答案：B。水平组

解析：本题考查牙周膜纤维。牙周膜中维持直立的主要纤维是水平组（B对）。牙骨膜组（D错）为牙龈纤维。牙周膜纤维有：1.牙槽嵴组（A错）：纤维起于釉牙骨质界下方的牙骨质，向外下方走行，止于牙槽嵴顶。主要分布在牙的唇（颊）、舌（腭）侧，在邻面无此纤维。其功能是将牙向牙槽窝内牵引，对抗侧方力，保持牙直立。2.水平组：在牙槽嵴组纤维的根方，起于牙骨质，呈水平方向走行，止于牙槽骨，是维持牙直立的主要力量，与牙槽嵴组纤维共同对抗侧向力，防止牙侧方移动。3.斜行组（C错）：是牙周膜中数量最多、力量最强的一组纤维。除牙颈部和根尖区外，都是斜行组纤维分布的区域。纤维起于牙骨质，以约45°角向牙槽嵴顶走行，止于牙槽骨。纤维附着牙骨质的一端近根尖部，而埋入牙槽骨的一端近牙颈部，将牙悬吊在牙槽窝内。这种结构可将牙承受的咀嚼压力转变为牵引力，均匀地分散到牙槽骨上。而在水平切面上，斜行组纤维的排列呈交织状，而不是直的放射状，可以限制牙的转动。4.根尖组：起于根尖区牙骨质，呈放射状止于根尖周围的牙槽骨，具有固定根尖的作用，保护进出根尖孔的血管和神经。5.根间组（E错）：只存在于多根牙，起自根分叉处的牙根间骨隔顶，止于根分叉区牙骨质，有防止牙根向冠方移动的作用。